第二心音固定分裂最常见于何种疾病
A. 动脉导管未闭
B. 室间隔缺损
C. 房间隔缺损
D. 右束支阻滞
E. 左束支传导阻滞

正确答案：C。房间隔缺损

解析：第二心音固定分裂是指第二心音不受呼吸影响，第二心音分裂的两种成分时距较固定，最常见于先天性心脏房间隔缺损（C对）。房间隔缺损时，呼气时左房向右房的血液分流使右心血流增加，排血时间延长，肺动脉瓣明显关闭延迟，第二心音形成分裂，吸气时右心房压力暂时升高同时造成左房向右房的血液分流稍减，抵消了吸气导致的回心血量增加的改变，因此第二心音分裂的时距较固定。动脉导管未闭（A错），听诊有胸骨左缘上方有一连续性“机器”样杂音。室间隔缺损（B错）听诊有胸骨左缘第3、4肋间可闻及Ⅲ-Ⅳ粗糙全收缩期杂音，向四周广泛传导。右束支阻滞（D错）听诊可有第一心音分裂。左束支传导阻滞（E错）听诊可有第二心音反常分裂。